生物氧化过程中释放的能量储存在一些特殊的磷酸酯键中，并且在水解时释放能量较多，称为
A. 肽键
B. 高能磷酸键
C. 低能离子键
D. 羧酸键
E. 碳氧键

正确答案：B。高能磷酸键

解析：高能磷酸键储存了生物氧化中释放的能量并且在水解时释放能量较多。用“～P”表示。掌握“ATP”知识点。